取供试品0.2g，加水20ml使溶解，分取10ml，加三硝基苯酚试液10ml，即生成沉淀，滤过，沉淀用水洗涤，在105℃干燥后，测定熔点为228℃～232℃用来鉴别
A. 对乙酰氨基酚
B. 盐酸普鲁卡因
C. 盐酸利多卡因
D. 诺氟沙星
E. 盐酸氯丙嗪

正确答案：C。盐酸利多卡因